“入芝兰之室久而不闻其香”
A. 感觉适应
B. 感觉减退
C. 感觉相互作用
D. 感觉过敏
E. 疲劳

正确答案：A。感觉适应

解析：嗅觉适应：“入芝兰之室，久而不闻其香”是嗅觉的适应（A对）。感觉减退是感觉变得迟钝或者缺失（B错）。感觉相互作用是指在一定条件下，各种不同的感觉都可能发生相互作用，从而使感受性发生变化的现象（C错）。感觉过敏，又称感觉增强，是感觉阈值降低或强烈的情绪因素造成，是皮肤对某些疾病引起的刺激感受性增高的表现，以痛觉过敏最为常见（D错）。